患者腰部冷痛重着，转侧不利，每逢阴雨天加重，静卧时其痛不减，舌苔白腻，脉沉缓。其治法是
A. 散寒行湿，温经通络
B. 清热利湿，舒筋止痛
C. 活血化瘀，理气止痛
D. 温补肾阳，补虚止痛
E. 滋补肾阴，补虚止痛

正确答案：A。散寒行湿，温经通络

解析：患者以腰部冷痛重着为主诉，故诊断为腰痛；当寒湿之邪，侵袭腰部，痹阻经络时，因寒性收引，湿性凝滞，故腰部冷痛重着，转侧不利；阴雨寒冷天气则寒湿更甚，故每逢阴雨天加重；湿为阴邪，得阳运始化，静卧则湿邪更易停滞，故静卧时其痛不减；舌苔白腻，脉沉缓，均为寒湿停聚之象，故其证候为寒湿腰痛证，治以散寒行湿，温经通络（A对）。清热利湿，舒筋止痛，是腰痛之湿热腰痛的治法(B错)。活血化瘀，理气止痛，是瘀血腰痛的治法（C错）。温补肾阳，补虚止痛，是肾虚腰痛证，偏于阳虚的治法（D错）。滋补肾阴，补虚止痛，是肾虚腰痛证，偏于阴虚的治法（E错）。